具有凉血功效的药物是
A. 石膏
B. 知母
C. 芦根
D. 天花粉
E. 栀子

正确答案：E。栀子

解析：该题考查栀子的功效，属记忆内容。栀子味苦，性寒，入心、肺、三焦经；其功效为泻火除烦，清热利湿，凉血解毒（E对）。石膏生用具有清热泻火，除烦止渴的功效，煅用具有敛疮生肌，收湿，止血的功效，无凉血之功（A错）。知母具有清热泻火，滋阴润燥的功效（B错）。芦根具有清热泻火，生津止渴，除烦，止呕，利尿的功效（C错）。天花粉具有清热泻火，生津止渴，消肿排脓的功效，无凉血之功（D错）。